根据《中华人民共和国药品管理法》经省级卫生行政部门审核同意后，报同级药品监督管理部门核发的是
A. 零售企业《药品经营许可证》
B. 《药品生产许可证》
C. 《医疗机构制剂许可证》
D. 《进口药品通关单》
E. 《进口药品注册证》

正确答案：C。《医疗机构制剂许可证》

解析：本题考察药品管理。根据《中华人民共和国药品管理法》经省级卫生行政部门审核同意后，报同级药品监督管理部门核发的是《医疗机构制剂许可证》（C对）。